男，30岁。咽疼、咳嗽、发热，2周后发现尿色红，眼睑浮肿，尿量1000ml/24h。体检：全身皮肤未见皮疹，血压150/100mmHg。化验：尿蛋白（++），红细胞50～60/HP，血白蛋白32g/L，血肌酐123μmol/L。上述临床表现最可能的诊断是
A. 急性链球菌感染后肾炎
B. 急性肾盂肾炎
C. 过敏性紫癜
D. 系统性红斑狼疮
E. 急性肾小管坏死

正确答案：A。急性链球菌感染后肾炎

解析：青年男性患者，咽疼、咳嗽、发热（考虑为链球菌引起的上呼吸道感染的表现），2周后发现尿色红（考虑有血尿），眼睑浮肿（提示有水肿），尿量1000ml/24h（正常为1000～2000ml/d）。体检：血压150/100mmHg（正常为90～130/60～90mmHg，提示有高血压）。化验：尿蛋白（++）（正常为尿蛋白阴性，提示有蛋白尿），红细胞50～60/HP（正常＜3/HP，提示有血尿），血白蛋白32g/L（正常为40～55g/L，提示有低白蛋白血症），血肌酐123μmol/L（正常为88.4～176.8μmol/L）。患者于链球菌感染1～3周内发生血尿、水肿、蛋白尿、高血压等急性肾炎综合征表现，最可能的诊断是急性链球菌感染后肾炎（A对）。